患者干咳，连声作呛，咽喉干痛，唇鼻干燥，痰少而粘，口干，伴身热微寒，舌质红干而少津，苔薄黄，脉浮数。其证候是
A. 风热犯肺
B. 风燥伤肺
C. 痰热郁肺
D. 肝火犯肺
E. 肺阴亏耗

正确答案：B。风燥伤肺

解析：风热犯肺，咳嗽多剧烈，气粗或咳声音哑，痰多黄稠（A错）。题中患者以干咳，连声作呛为主要症状，诊断为咳嗽，干咳，连声作呛为风燥伤肺，肺失清润所致，燥热灼津故咽喉干痛，唇鼻干燥，痰少而粘，口干，风燥伤肺，卫表不和故身热微寒，舌质红干而少津，苔薄黄，脉浮数为燥邪伤肺之证，故辨为风燥伤肺证（B对）。痰热郁肺，咳嗽气息粗促，喉中有痰声，痰多质粘厚黄稠，可咯血痰（C错）。肝火犯肺，则气逆作咳阵作，咳时面红目赤，咳引胸痛，症状多随情绪波动变化（D错）。肺阴亏耗则干咳，咳声短促，痰少粘白，声音逐渐嘶哑，可伴痰中带血（E错）。